女，25岁，阴道分泌物增多伴外阴瘙痒3天，妇科检查，阴道黏膜充血，后穹窿有大量稀薄、黄绿色、泡沫状、有臭味分泌物。该患者最可能的诊断是
A. 细菌性阴道病
B. 滴虫阴道炎
C. 子宫内膜炎
D. 萎缩性阴道炎
E. 外阴阴道假丝酵母病

正确答案：B。滴虫阴道炎

解析：女性患者，阴道分泌物增多伴外阴瘙痒，分泌物稀薄、呈黄绿色（合并其他细菌感染）、泡沫状、有臭味（滴虫阴道炎分泌物典型特点），阴道黏膜充血。据患者临床表现，实验室检查，最可能的诊断是滴虫阴道炎（B对）。细菌性阴道病（A错）临床特点为鱼腥臭味的稀薄阴道分泌物增加，但阴道检查无炎症改变。萎缩性阴道炎（D错）常见于雌激素缺乏患者，主要症状为外阴灼热不适、瘙痒，阴道分泌物稀薄，呈淡黄色；感染严重者阴道分泌物呈脓血性，可伴有性交痛。妇科检查见阴道皱襞消失、萎缩、菲薄，阴道黏膜充血。外阴阴道假丝酵母病（E错）主要症状为外阴阴道瘙痒、灼热痛，阴道分泌物呈豆渣状或凝乳样。